患者，女，36岁。两大腿内侧患有钱币形红斑2枚，自觉瘙痒，边界清楚，中央有向愈趋向，多在夏季加重，其诊断是
A. 紫白癜风
B. 圆癣
C. 多形性红斑
D. 牛皮癣
E. 肥疮

正确答案：B。圆癣

解析：圆癣，相当于西医的体癣，以青壮年男性多见，多发于夏季，好发于面部、颈部、躯干、四肢等处，其特点：初起为丘疹或水疱，逐渐形成边界清楚的钱币形红斑，其上覆盖细薄鳞屑，以后病灶中央常有自愈倾向，而向四周蔓延，有丘疹、水疱、脓疱、结痂等损害，日久形成环形，多环形后同心环形等多种形态，有不同程度的瘙痒感，本病例大腿内侧有钱币形红斑，瘙痒，边界清楚，中央有向愈趋向，皮损特点与之相符，故诊断为圆癣（B对）。紫白癜风，因病变处损害以紫斑、白斑而得名，又因夏季出汗后皮疹明显，俗称汗斑，相当于西医的花斑癣，其特点是初起皮肤上出现豌豆到蚕豆大小的斑片，色淡红或赤紫，继则游走成片，上有细小糠秕状鳞屑，刮之更明显，微微发亮，将愈时呈灰白色斑片，好发于颈侧、胸背、肩胛、腋窝，下部躯干、乳下、会阴等处，冬轻夏重，本病例发病部位及时间特点与之相似，但皮疹特点与之不符（A错）。多形性红斑，即猫眼疮，是以红斑为主，兼有丘疹、水疱等多形性皮损的急性炎症性皮肤病，其特点是发病急骤，皮损为丘疹、水疱等多形性损害和具有虹膜样特征的红斑，本病例皮损特点与之不符（C错）。牛皮癣，是一种皮肤状如牛项之皮，厚且坚的慢性瘙痒性皮肤病，相当于西医的神经性皮炎，其特点是，皮损圆形或多角形的扁平丘疹融合成片，剧烈瘙痒，搔抓后皮损肥厚，皮沟加深，皮嵴隆起，极易形成苔癣样病变，本病例皮损特点与之不符（D错）。肥疮，相当于西医的黄癣，有传染性，多见于儿童，其特点是初起红色丘疹，后有脓疱，干后结痂，颜色蜡黄，形成黄癣痂，扩大融合成片，可散发似鼠屎的臭味，自觉瘙痒，头发干燥，失去光泽，病变先从头顶部开始，逐渐向四周扩大，可侵及整个头皮，本病例特点与之不符（E错）。